动物实验结果表明洗涤剂的危害不包括
A. 肺脏
B. 肝脏
C. 皮肤
D. 肾脏
E. 免疫系统

正确答案：A。肺脏

解析：本题考查动物实验结果表明洗涤剂的危害。动物实验结果表明洗涤剂的危害包括：1.影响肝功能（B对），可引起脂代谢紊乱；2.影响肾上腺功能（D对），可对肾上腺髓质和皮质产生影响；3.影响免疫系统（E对），抑制体液免疫功能；4.具有皮肤毒性（C对），可致皮肤损害。洗涤剂的危害不包括肺脏功能（A错，为本题正确答案）。